凡是脂/水分配系数大，非离子性化合物通过生物膜方式
A. 简单扩散
B. 滤过
C. 主动转运
D. 载体扩散
E. 胞饮和吞噬

正确答案：A。简单扩散

解析：本题考查化学毒物通过生物膜的方式。凡是脂/水分配系数大，非离子性化合物通过生物膜方式为简单扩散（A对BCDE错）。